关于药品命名的说法，正确的是
A. 药品不能申请商品名
B. 药品通用药名可以申请专利和行政保护
C. 药品化学名是国际非专利药品名称
D. 制剂一般采用商品名加剂型名
E. 药典中使用的名称是通用名

正确答案：E。药典中使用的名称是通用名

解析：本题考查药品命名。关于药品命名的说法，正确的是药典中使用的名称是通用名（E对）。我国药典委员会编写的《中国药品通用名称》是中国药品命名的依据，所以药典中使用的名称是药品通用名。药品通用名不受专利和行政保护（B错），是所有资料、文献、教材以及药品说明书中标明有效成分的名称。药品可以申请商品名（A错），是因为药品商品名是由制药企业自己进行选择的，它和商标一样可以进行注册和申请专利保护。药品的化学名不是国际非专利药品名称（C错），国际非专利药品名称是药品通用名。药物制剂是指将原料药物按照某种剂型制成一定规格并具有一定质量标准的具体品种，简称制剂，根据制剂命名原则，制剂名=药物通用名+剂型名（D错）。